女，31岁。婚后3年不孕。患者平素月经规律，妇科检查未发现异常，内分泌检查正常，造影示双侧输卵管堵塞。适宜的辅助生育技术是
A. 人工授精
B. 植入前遗传学诊断技术
C. 配子输卵管内移植
D. 胞浆内单精子注射
E. 体外受精与胚胎移植

正确答案：E。体外受精与胚胎移植

解析：女，31岁。婚后3年不孕。患者平素月经规律，妇科检查未发现异常，内分泌检查正常，造影示双侧输卵管堵塞。适宜的辅助生育技术是体外受精与胚胎移植（E对）。体外受精与胚胎移植技术是指从女性卵巢内取出卵子，在体外与精子发生授精并培养3～5日，再将发育到卵裂球期或囊胚期阶段的胚胎移植到宫腔内，使其着床发育成胎儿的全过程，俗称“试管婴儿”。人工授精是将精子通过非性交方式注入女性生殖道内，使其受孕，而该女性患者双侧输卵管堵塞，精子与卵子无法结合（A错）。植入前遗传学诊断技术（B错）主要用于单基因相关遗传病、染色体病、性连锁遗传病及可能生育异常患儿的高风险人群等。该患者无相关基因遗传病等，所以不选。配子输卵管内移植（C错）是将男女生殖细胞取出，并经适当处理后移植入女性体内的一种助孕技术，适用于输卵管堵塞患者，但以逐渐被体外培养技术替代，只作为备选。胞浆内单精子注射（D错）是将精子直接注射到卵细胞浆内，获得正常卵子授精和卵裂过程，但该患者无法正常排卵，且未告知丈夫有精子异常。